患者跌打损伤后，瘀血留于胁下，痛不可忍。治疗应选用
A. 血府逐瘀汤
B. 温经汤
C. 生化汤
D. 复元活血汤
E. 大黄䗪虫九

正确答案：D。复元活血汤

解析：患者跌打损伤后，瘀血留于胁下，痛不可忍。因跌打损伤，淤血滞留胁下，气机阻滞所致。胁肋为肝经循行所处，跌打损伤，淤血停留，气机阻滞，故见胁肋瘀肿疼痛，甚至痛不可忍。治当活血祛瘀，兼以疏肝行气通络。方用复原活血汤。为治疗跌打损伤，瘀血阻滞的常用方。酒制大黄，荡涤凝淤败血，导淤下行，推陈致新；柴胡疏肝行气，并引诸药入肝经。桃仁、红花活血祛瘀，消肿止痛；穿山甲破瘀通络，消肿散结，当归补血活血，栝楼根入血分助诸药消瘀散结，又可清热燥湿，甘草缓急止痛（D对）。血府逐瘀汤方证主治诸症皆为淤血内阻胸隔，气机瘀滞所致。本方用于因胸中瘀血而引起的多种病证（A错）。温经汤方证因冲任虚寒，瘀血阻滞所致。冲为血海，任主胞胎，二脉皆起于胞宫，循行于少腹，与经、产关系密切。为妇科调经的常用方（B错）。生化汤方证由产后血虚寒凝，淤血内阻所致。为妇女产后常用方（C错）。大黄䗪虫九方证多因过饱、过饥、忧郁、暴饮、或房事、疲劳过度等而成（E错）。